氨在肝中合成尿素的主要中间物质是
A. 丙氨酸和谷氨酰胺
B. 谷氨酸和丙氨酸
C. 瓜氨酸和精氨酸
D. 半胱氨酸和瓜氨酸
E. 组氨酸和赖氨酸

正确答案：C。瓜氨酸和精氨酸